根据药品安全隐患的严重程度，药品召回分为三级。其中，一级召回的管理要求是
A. 一级召回只适用于使用后可能引起暂时的或可逆的健康危害的药品
B. 在启动召回计划3日内应将调查评估报告和召回计划提交给国家药品监督管理部门备案
C. 在作出召回决定后24小时内应通知有关药品经营企业、使用单位停止销售和使用需召回的药品
D. 药品生产企业应每日向国家药品监督管理部门报告召回进展情况

正确答案：C。在作出召回决定后24小时内应通知有关药品经营企业、使用单位停止销售和使用需召回的药品

解析：本题考查的是召回的时间规定。根据药品安全隐患的严重程度，药品召回分为三级。其中，一级召回的管理要求是在作出召回决定后24小时内应通知有关药品经营企业、使用单位停止销售和使用需召回的药品（C对）。药品召回分级：根据药品安全隐患的严重程度，药品召回分为三级：对使用该药品可能引起严重健康危害的实施一级召回（A错）；对使用该药品可能引起暂时的或者可逆的健康危害的实施二级召回；对使用该药品一般不会引起健康危害，但由于其他原因需要收回的实施三级召回。药品召回的时间规定：1.主动召回：药品生产企业在作出药品召回决定后，应当制定召回计划并组织实施：一级召回在24小时内，二级召回在48小时内，三级召回在72小时内，通知到有关药品经营企业、使用单位停止销售和使用，同时向所在地省级药品监督管理部门报告。药品生产企业在启动药品召回后，一级召回在1日内，二级召回在3日内，三级召回在7日内，应当将调查评估报告和召回计划提交给所在地省级药品监督管理部门备案（B错）。省级药品监督管理部门应当将收到一级药品召回的调查评估报告和召回计划报告国家药品监督管理部门。药品生产企业在实施召回的过程中，一级召回每日，二级召回每3日，三级召回每7日，向所在地省级药品监督管理部门报告药品召回进展情况（D错）。2.责令召回：药品生产企业被要求执行药品召回决定后，应当制定召回计划并组织实施，一级召回在24小时内，二级召回在48小时内，三级召回在72小时内，通知到有关药品经营企业、使用单位停止销售和使用，同时向所在地省级药品监督管理部门报告。药品生产企业在启动药品召回后，一级召回在1日内，二级召回在3日内，三级召回在7日内，应当将调查评估报告和召回计划提交给所在地省级药品监督管理部门备案。省级药品监督管理部门应当将收到一级药品召回的调查评估报告和召回计划报告国家药品监督管理部门。